药物吸收后可以
A. 经肾脏排出
B. 经肺排出
C. 经肠道排出
D. 经胆囊排出
E. 经乳汁排出

正确答案：A、B、C、D、E。经肾脏排出；经肺排出；经肠道排出；经胆囊排出；经乳汁排出

解析：本题考查药物的排泄途径。药物吸收后可以经肾脏排出（A对）、经肺排出（B对）、经肠道排出（C对）、经胆囊排出（D对）、经乳汁排出（E对）。药物的排泄途径主要是通过肾脏排出体外，也有一些药物通过肺、肠道、胆囊、乳汁排出。